鉴别严重肝病出血与DIC出血最有价值的实验室检查项目是
A. 凝血酶原时间
B. AT-Ⅲ含量及活性
C. 血浆FⅧ活性
D. 纤溶酶原
E. 纤维蛋白原

正确答案：C。血浆FⅧ活性

解析：凝血因子FⅧ是由肝间质组织的单核巨噬细胞系统合成的，严重肝病时，尽管大多数凝血因子合成减少，活性降低，但由于肝库普弗细胞功能亢进，血浆FⅧ：C活性增强，而DIC时凝血因子消耗过多，导致包括FⅧ在内的所有凝血因子活性均降低，故血浆FⅧ：C活性（C对）是二者鉴别最有价值的实验室检查项目。凝血酶原时间（A错）反映外源性凝血系统的功能，纤维蛋白原（E错）反映共同凝血途径的功能，AT-Ⅲ（抗凝血酶-Ⅲ）含量及活性（B错）反映抗凝血系统功能，纤溶酶原（D错）反映纤溶系统功能，严重肝病与DIC时均减低。